疏肝破气的药物是
A. 陈皮
B. 青皮
C. 香附
D. 沉香
E. 大腹皮

正确答案：B。青皮

解析：青皮苦、辛，温；入肝、胆、胃经。苦泄辛行宜通，性猛入肝，善于疏理肝胆之气，尤宜于肝郁气滞诸症；苦泄峻烈，辛散温通力强，能破气散结（B对）；辛行苦降，既能消积，又能行气止痛。